描述传染病流行病学特征，不正确的是
A. 暴发
B. 流行
C. 隐性感染
D. 散发
E. 大流行

正确答案：C。隐性感染

解析：散发（D对）是传染病发病处于常年一般水平，人群免疫力高或隐性感染率较高或不容易传播。暴发（A对）是在短期突然出现许多同一疾病患者。流行（B对）是某病发病率处于显著超过该病常年发病率或为散发发病率数倍。大流行（E对）某病一定时间内传播范围较广，波及全国、超过国界或洲境。隐性感染（C错，为本题正确答案）是感染过程的表现，不属于传染病流行病学特征。